当胃酸分泌过少时，不受影响的是
A. 胃蛋白酶对蛋白质的消化
B. 对细菌抑制杀灭作用
C. 胰液和胆汁的分泌
D. 钙和铁的吸收
E. 维生素B₁₂的吸收

正确答案：E。维生素B₁₂的吸收

解析：维生素B₁₂的吸收是回肠的功能，和胃酸的分泌没有关系，但胃酸分泌减少会引起内因子分泌减少，导致维生素B₁₂吸收障碍（E错）。胃酸可以使食物中的蛋白质变性，有利于蛋白质的水解，当胃酸分泌过少时，胃蛋白酶对蛋白质的消化减弱（A错）。胃酸可以杀灭随食物进入胃内的细菌，当胃酸分泌过少时，对细菌抑制杀灭作用减弱（B错）。盐酸随食糜进入小肠后，可促进促胰液素和缩胆囊素的分泌，进而引起胰液、胆汁和小肠液的分泌，当胃酸分泌过少时，对胰液和胆汁的分泌促进作用减弱（C错）。盐酸造成的酸性环境有利于小肠对铁和钙的吸收，当胃酸分泌减少时，对钙和铁的吸收减弱（D错），因此本题无正确答案，原答案选择E。